磷酸钙在片剂中作为
A. 润湿剂
B. 润滑剂
C. 吸收剂
D. 黏合剂
E. 崩解剂

正确答案：C。吸收剂